肾功能不全者慎用的中成药
A. 清宁丸
B. 麻仁丸
C. 通便灵胶囊
D. 复方芦荟胶囊
E. 苁蓉通便口服液

正确答案：D。复方芦荟胶囊

解析：本题考查的是复方芦荟胶囊的注意事项。肾功能不全者慎用的中成药复方芦荟胶囊（D对）。复方芦荟胶囊的注意事项：不宜长期服用，哺乳期妇女及肝肾功能不全者慎用。清宁丸（A错）的注意事项：孕妇忌服。麻仁丸（B错）的注意事项：孕妇忌服。通便灵胶囊（C错）的注意事项：孕妇忌服。苁蓉通便口服液（E错）的注意事项：孕妇慎用。